某女，38岁，近日心神烦乱，失眠多梦，心悸不宁，舌尖红，脉细数，证属心火亢盛、阴血不足，宜选用的成药是
A. 天王补心丸
B. 人参归脾丸
C. 柏子养心片
D. 枣仁安神液
E. 朱砂安神丸

正确答案：E。朱砂安神丸

解析：本题考查的是朱砂安神丸的主治。近日心神烦乱，失眠多梦，心悸不宁，舌尖红，脉细数，证属心火亢盛、阴血不足，宜选用的成药是朱砂安神丸（E对）。朱砂安神丸：【主治】心火亢盛、阴血不足证，症见心神烦乱、失眠多梦、心悸不宁、舌尖红、脉细数。天王补心丸（A错）：【主治】心阴不足，心悸健忘，失眠多梦，大便干燥。人参归脾丸（B错）：【主治】心脾两虚、气血不足所致的心悸、怔忡、失眠健忘、食少体倦、面色萎黄，以及脾不统血所致的便血、崩漏、带下。柏子养心片（C错）：【主治】心气虚寒，心悸易惊，失眠多梦，健忘。枣仁安神液（D错）：【主治】心血不足所致的失眠、健忘、心烦、头晕；神经衰弱症见上述证候者。